坐骨肛门窝
A. 位于坐骨体与肛门之间
B. 为底朝上尖向下的锥形
C. 外侧壁为肛提肌
D. 内有阴部管通过
E. 内侧壁为闭孔内肌

正确答案：D。内有阴部管通过

解析：坐骨肛门窝位于坐骨结节与肛门之间(A错)，为底朝下尖向上的锥形(B错)，外侧壁为闭孔内肌(C错)，内部有阴部管通过(D对)，内侧壁为肛提肌(E错)。